下列不属于氯丙嗪不良反应的是
A. 帕金森综合征
B. 抑制体内催乳素分泌
C. 急性肌张力障碍
D. 患者出现坐立不安
E. 迟发性运动障碍

正确答案：B。抑制体内催乳素分泌